既收敛止血，又截疟的药是
A. 地榆
B. 藕节
C. 棕榈炭
D. 紫珠叶
E. 仙鹤草

正确答案：E。仙鹤草

解析：本题考查的是仙鹤草的功效。既收敛止血，又截疟的药是仙鹤草（E对）。仙鹤草：【功效】收敛止血，止痢，截疟，解毒，杀虫，补虚。地榆（A错）：【功效】凉血止血，解毒敛疮。藕节（B错）：【功效】收敛止血。棕榈炭（C错）：【功效】收敛止血。紫珠叶（D错）：【功效】收敛凉血止血，散瘀解毒消肿。